永久硬度指
A. 溶解性固体和悬浮性固体
B. 钙、镁的重碳酸盐
C. 钙、镁的硫酸盐和氧化物
D. 水中不能除去的钙、镁盐类
E. 溶解于水中的钙、镁盐类总和

正确答案：D。水中不能除去的钙、镁盐类

解析：本题考查永久硬度。永久硬度指水煮沸后不能去除的硬度，如水中不能除去的钙、镁盐类（D对ABCE错）。